用人单位应当履行下列责任，但除外
A. 在疑似职业病患者诊断或者医学观察期间，不得解除或者终止与其订立的劳动合同
B. 承担疑似职业病患者在诊断，医学观察期间的费用
C. 对不适宜连续从事原工作的职业病患者，应当调离原岗位，并妥善安置
D. 应当按照国家有关规定，安排职业病患者进行治疗、康复和定期检查
E. 组织控制职业病危害事故现场

正确答案：E。组织控制职业病危害事故现场